可用坂口反应进行鉴别的药物是
A. 氨苄西林
B. 头孢羟氨苄
C. 硫酸庆大霉素
D. 硫酸链霉素
E. 盐酸美他环素

正确答案：D。硫酸链霉素

解析：本题考查亚硝酸钠滴定法。磺胺甲噁唑片含量测定使用的滴定液为亚硝酸钠滴定液（D对）。磺胺甲噁唑为芳香伯胺类药物，在盐酸存在下，能定量地与亚硝酸钠产生重氮化反应。硫酸铈滴定液（A错）是铈量法的滴定液。硝酸银滴定（B错）是沉淀滴定法的滴定液。氢氧化钠滴定液（C错）是酸碱滴定法的滴定液。碘滴定液（E错）是碘量法的滴定液。